手术时辨认幽门的重要标志是
A. 角切迹
B. 中间沟
C. 胃小凹
D. 幽门前静脉
E. 胃右静脉

正确答案：D。幽门前静脉

解析：幽门前静脉(D对)为手术时辨认幽门的重要标志。